用于抢救急性左心衰的措施是
A. 服速效救心丸
B. 静脉滴注葡萄糖液
C. 静脉注射利尿剂
D. 静脉滴注生理盐水
E. 服丹参滴丸

正确答案：C。静脉注射利尿剂

解析：用于抢救急性左心衰的措施是静脉注射利尿剂（C对）。服速效救心丸适用于心绞痛、冠心病（A错）。静脉滴注葡萄糖液适用于低血糖症（B错）。静脉滴注生理盐水适用于休克或酸碱平衡失衡（D错）。服丹参滴丸适用于稳定型心绞痛（E错）。